开办零售药店，必须经批准筹建后，提出验收申请，合格后方可取得《药品经营许可证》，并在规定时限内提出《药品经营质量管理规范》认证，其规定时限是
A. 取得《药品经营许可证》之日起7个工作日
B. 取得《药品经营许可证》之日起15个工作日
C. 取得《药品经营许可证》之日起30日内
D. 取得《药品经营许可证》之日起3个月内
E. 取得《药品经营许可证》之日起6个月内

正确答案：C。取得《药品经营许可证》之日起30日内

解析：本题考查药品经营。开办零售药店，必须经批准筹建后，提出验收申请，合格后方可取得《药品经营许可证》，并在取得《药品经营许可证》之日起30日内（C对）提出《药品经营质量管理规范》认证。